解救苯巴比妥重度中毒昏迷患者时为加速毒物排泄应首选
A. 静脉注射维生素C以酸化尿液
B. 口服维生素C以酸化尿液
C. 静滴5%碳酸氢钠以碱化尿液
D. 口服碳酸氢铵以碱化尿液
E. 静滴10%葡萄糖注射剂以促进毒物排泄

正确答案：C。静滴5%碳酸氢钠以碱化尿液

解析：本题考查巴比妥类药物中毒解救。解救苯巴比妥重度中毒昏迷患者时为加速毒物排泄应首选静滴5%碳酸氢钠以碱化尿液（C对）。尿液PH值决定药物的解离度，影响药物的肾小管再吸收，从而影响其排泄。5%碳酸氢钠应静脉滴注（D错）以碱化尿液，加速排泄。苯巴比妥为酸性药物，为加速其排泄应碱化尿液（AB错）。可以静脉滴注5%葡萄糖（E错）和0.9%氯化钠注射液各半以补液。